儿科一门诊患者，身高处于其年龄相应标准的第3百分位数之下。经检测，他的甲状腺素水平低于正常。以下关于其骨龄（BA）、身高年龄（HA）、时间年龄（CA）的关系正确的是
A. HA＝BA﹤CA
B. BA﹤CA﹤HA
C. BA﹤HA﹤CA
D. HA﹤BA＝CA
E. HA＝BA﹥CA

正确答案：C。BA﹤HA﹤CA